任何一种窒息性气体的主要致病环节是
A. 缺氧
B. 呼吸困难
C. 昏迷
D. 刺激
E. 变性血红蛋白症

正确答案：A。缺氧